阻碍根管治疗的是
A. 弥散性钙化
B. 髓石
C. 牙髓炎
D. 根尖周炎
E. 牙髓息肉

正确答案：A。弥散性钙化

解析：本题考查牙髓病。阻碍根管治疗的弥散性钙化（A对）。弥漫性钙化，甚至可造成整个髓腔闭锁，阻碍根管治疗。